肝性脑病时使用门冬氨酸鸟氨酸的原因为
A. 抑制细菌减少氨气形成
B. 维持氨基酸平衡
C. 减少氨的吸收
D. 促进氨代谢
E. 减少假性神经递质产生

正确答案：D。促进氨代谢

解析：门冬氨酸鸟氨酸即L-鸟氨酸-L-天冬氨酸，鸟氨酸能增加氨基甲酰磷酸合成酶和鸟氨酸氨基甲酰转移酶活性，其本身也可通过鸟氨酸循环合成尿素而降低血氨，天冬氨酸可促进谷氨酰胺合成酶活性，促进脑、肾利用和消耗氨以合成谷氨酸和谷氨酰胺而降低血氨，故答案选择促进氨的代谢（D对）。通过口服抗生素可抑制细菌减少氨气形成（A错）。服用乳果糖可降低肠道PH，减少氨的吸收（C错）。补充支链氨基酸有助于减少假性神经递质的形成（E错）。